医疗机构不得采用的供药方式有
A. 未经诊疗直接为患者提供处方药
B. 通过邮售方式直接向患者销售处方药
C. 通过互联网方式直接向患者销售处方药
D. 按国家有关规定向患者提供麻醉药品
E. 提供医疗机构制剂给基层医疗卫生机构使用

正确答案：A、B、C、E。未经诊疗直接为患者提供处方药；通过邮售方式直接向患者销售处方药；通过互联网方式直接向患者销售处方药；提供医疗机构制剂给基层医疗卫生机构使用

解析：本题考查供药方式。医疗机构不得未经诊疗直接为患者提供药品（A错，为本题正确答案），也不可以采取邮售和互联网方式供应药品（BC错，为本题正确答案）。医疗机构制剂凭执业医师或者执业助理医师的处方在本单位内部使用，特殊情况下，经国家或省级药品监督管理部门批准，可在指定的医疗机构之间调剂使用（E错，为本题正确答案）。